理中丸是临床常用的中成药，其处方的君药是
A. 党参
B. 炮姜
C. 饴糖
D. 土炒白术
E. 炙甘草

正确答案：B。炮姜

解析：本题考查的是理中丸的方义简释。理中丸的君药是炮姜（B对）。理中丸：【方义简释】方中炮姜苦辛温散，微涩兼收，入脾、胃经，既善温中祛寒以治本，又能止泻、止痛以治标，故为君药。党参（A错）甘补而平，不燥不腻，善补气健脾，培补后天之本，以助君药振奋脾阳而祛寒健胃，故为臣药。土炒白术（D错）甘补渗利，苦温而燥，善益气健脾、燥湿利水，可助君臣药燥脾湿、复脾运、升清阳、降浊阴，故为佐药。炙甘草（E错）甘补和缓，平而偏温，善补脾益气、缓急止痛，兼调和诸药，故为使药。全方配伍，辛热祛寒，甘温补中，共奏温中祛寒、健胃之功，故治脾胃虚寒所致的呕吐泄泻、胸满腹痛、消化不良。